某男，42岁。自诉感冒数日，恶寒渐轻，身热增盛，无汗头痛，目疼鼻干，心烦不眠。经中医辨证为外感风寒、郁而化热。处以柴葛解肌汤，药用柴胡、葛根、甘草、黄芩、羌活、白芷、白芍、桔梗、石膏，水煎服。处方调配复核，见有表面黑褐色，切面外侧棕褐色，木部黄白色，有的可见放射状纹理，气香的饮片是
A. 葛根
B. 黄芩
C. 羌活
D. 白芍
E. 桔梗

正确答案：C。羌活

解析：本题考查的是羌活饮片的鉴别。处方调配复核，见有表面黑褐色，切面外侧棕褐色，木部黄白色，有的可见放射状纹理，气香的饮片是羌活（C对）。羌活：【性状鉴别】饮片为类圆形、不规则横切或斜切片。表皮棕褐色至黑褐色，切面外侧棕褐色，木部黄白色，有的可见放射状纹理。体轻，质脆。气香，味微苦而辛。葛根（A错）：【性状鉴别】饮片呈不规则的厚片、粗丝或方块。切面浅黄棕色至棕黄色。质韧，纤维性强。气微，味微甜。黄芩（B错）：【性状鉴别】饮片黄芩片为类圆形或不规则形薄片，外表皮黄棕色至棕褐色，切面黄棕色或黄绿色，具有放射状纹理。白芍（D错）：【性状鉴别】饮片多呈类圆形的薄片。表面淡棕红色或类白色。切面微带棕红色或类白色，形成层环明显，可见稍隆起的筋脉纹呈放射状排列。气微，味微苦、酸。桔梗（E错）：【性状鉴别】饮片呈椭圆形或不规则厚片，外皮多已除去或偶有残留。切面皮部黄白色，较窄；形成层环纹明显，棕色；木部宽，有较多裂隙。气微，味微甜后苦。